患者，女，25岁，3个月前因工作失误受到领导批评，觉得脸上无光，整日闷闷不乐，脑子里反复考虑自己的错误，觉得同事看不起她，在背后议论她，不愿意出门，并出现失眠，早醒，近一周来，出现兴奋话多，自我感觉好，觉得自己能做国家领导。该患者目前可能患
A. 抑郁症
B. 精神分裂症
C. 帕金森病
D. 躁狂发作
E. 阿尔茨海默病

正确答案：D。躁狂发作

解析：青年患者，3个月前因工作失误受到领导批评，整日闷闷不乐，脑子里反复考虑自己的错误，觉得同事看不起她，在背后议论她，不愿意出门，并出现失眠，早醒，近一周来，出现兴奋话多，自我感觉好（躁狂发作的典型症状），觉得自己能做国家领导（典型夸大观念），根据患者的临床症状，考虑最可能的诊断为双相障碍，且目前为躁狂发作（D对），该病典型症状为“三高”症状，即情感高涨、思维奔逸、活动增多。抑郁症（A错）主要表现为无望、无助、无价值；自责、自罪、自杀。精神分裂症（B错）是指以明显的阳性症状、阴性症状、精神运动性障碍及现实检验能力严重受损为特征的一组精神障碍。帕金森病（C错）常见于中老年的神经 系统变性疾病，临床上以静止性震颤、运动迟缓、肌强直和姿势平衡障碍为主要特征。阿尔茨海默病（E错）多见于老年和老年前期、以进行性认知功能障碍和行为损害为特征的中枢神经系统退行性病变。